患者突然昏仆，不省人事，肢体软瘫，目合口张，鼻鼾息微，手撒肢冷，汗多，二便自遗，舌痿，脉微欲绝。其中风属
A. 中经络
B. 阳闭证
C. 阴闭证
D. 脱证
E. 后遗症

正确答案：D。脱证

解析：题中患者以突然昏仆，不省人事为主症，故诊断为中风。阳浮于上，阴竭于下，阴阳有离决之势，正气虚脱，心神颓败，故见突然昏仆，不省人事，肢体软瘫，目合口张，鼻鼾，手撒，二便自遗，舌痿等五脏败绝的危症；息微，肢冷，汗多，脉微欲绝等均是阴精欲绝，阳气暴脱之征。故辩证为中风中脏腑脱证（D对）。中经络者虽由半身不遂、口眼歪斜、语言不利，但意识清楚（A错）。阳闭证可见瘀热痰火之象，如身热面赤、气粗鼻鼾、痰声如拽锯、便秘溲黄、舌苔黄腻、舌绛干，甚则舌体卷缩，脉弦滑而数（B错）。阴闭证可见寒湿痰浊之征，如面白唇紫、痰涎壅盛、四肢不温、舌苔白腻、脉沉滑等（C错）。后遗症为发病半年以上者，可见半身不遂，言语不利，口眼斜等（E错）。